下列条件中，可以做出环境污染健康影响评价病因判断的是
A. 关联的时间顺序和关联的强度
B. 关联的剂量-反应关系、关联的时间顺序和关联的强度
C. 暴露与疾病分布的一致性、关联的时间顺序和关联的强度
D. 关联可重复性、关联的剂量-反应关系
E. 关联可重复性、暴露与疾病分布的一致性、关联的时间顺序和强度

正确答案：E。关联可重复性、暴露与疾病分布的一致性、关联的时间顺序和强度

解析：本题考查环境污染健康影响评价病因判断。对病因作出综合评价需要根据7项标准：①关联的时间顺序；②关联的强度；③关联的剂量-反应关系；④暴露与疾病分布的一致性；⑤关联可重复性；⑥生物学合理性；⑦终止效应等。病因判定要求研究结果在满足前四条中的任何三条及后三条中的任何一条时，可判定因果关系。因此可以做出环境污染健康影响评价病因判断的是关联可重复性、暴露与疾病分布的一致性、关联的时间顺序和强度（E对ABCD错）